患者，女性，45岁，右下后牙颊侧牙龈肿胀、疼痛3天。检查：右下第一、二磨牙间颊侧牙龈呈卵圆形膨隆，有波动感，右下第一磨牙松动Ⅱ度。诊断是急性牙周脓肿。若与牙槽脓肿鉴别诊断，不必要的一项检查是
A. 牙髓活力
B. 牙周袋的存在
C. X线片
D. 是否有龈下牙石
E. 叩痛程度

正确答案：D。是否有龈下牙石

解析：牙周脓肿和牙槽脓肿的鉴别一般从以下方面：感染来源，病史，牙体情况，牙髓活力，牙周袋，脓肿部位脓肿范围，疼痛程度，牙松动度，叩痛，X线表现，病程。是否有龈下牙石不是鉴别要点。掌握“牙周脓肿”知识点。